判断风湿热活动性的指标不包括
A. 血沉增快
B. C反应蛋白升高
C. ASO阳性
D. 发热、乏力
E. a2-球蛋白增高

正确答案：C。ASO阳性

解析：ASO阳性（C错，为本题正确答案），只能表明近期内有A组乙型溶血性链球菌感染，不能判断是否处于风湿热活动期。风湿热活动指标有，血沉增快（A对）、C反应蛋白升高（B对）、发热、乏力（典型临床表现，C对），a2-球蛋白增高（D对）。